与胃MALT淋巴瘤发病相关的病原体是
A. EBV
B. HIV
C. HBV
D. CMV
E. HP

正确答案：E。HP

解析：与胃MALT淋巴瘤发病相关的病原体是HP，即幽门螺杆菌（E对）。EBV（P583）（A错）即EB病毒，是与鼻咽癌、Burkitt淋巴瘤发病相关的病原体；HIV（B错）即人类免疫缺陷病毒，是艾滋病的病原体；HBV（C错）即乙型肝炎病毒，是乙型病毒性肝炎的病原体；CMV（D错）即巨细胞病毒，与胃MALT淋巴瘤发病无关。